乙胺丁醇最常见的不良反应是
A. 皮疹
B. 药物热
C. 胃肠道刺激
D. 肾功能损害
E. 球后视神经炎

正确答案：E。球后视神经炎

解析：乙胺丁醇最常见且较严重的毒性反应为球后视神经炎（E对），表现为弱视、视野缩小、红绿色盲等，其发生率与剂量相关，停药可恢复，皮疹和药物热可出现，但发生率不及球后视神经炎（AB错）。偶见胃肠道反应（C错）。目前尚未明确指出有肾功能损害，但肾功能减退者须慎用（D错）。